胎心变化中与胎儿窘迫无关的是
A. 胎心率＞160次/分
B. 胎心率＜120次/分
C. 胎心早期减速
D. 胎心晚期减速
E. 胎心变异减速

正确答案：C。胎心早期减速

解析：胎心早期减速（C错，为本题正确答案）与胎儿窘迫无关，为宫缩时胎头受压引起，不受孕妇体位或吸氧而改变。缺氧早期（八年制妇产科学第二版P92），胎儿处于代偿期，胎心率于无宫缩时增快，＞160bpm（A对）。缺氧严重时（八年制妇产科学第二版P92），胎儿失代偿，胎心率＜120bpm（B对）。缺氧早期，胎儿电子监护可出现胎心基线代偿性加快、晚期减速（D对）或重度变异减速（E对）。